肝硬化失代偿期诊断主要依据是
A. 乏力，食欲不振
B. 消瘦
C. 腹胀、腹泻
D. 腹水
E. 肝掌

正确答案：D。腹水